不经肝门出入的结构是
A. 肝左、右管
B. 肝固有动脉的左、右支
C. 肝门静脉左、右支
D. 肝静脉
E. 肝的神经和淋巴管

正确答案：D。肝静脉

解析：肝左、右管(A对)、肝固有动脉的左、右支(B对)、肝门静脉左、右支(C对)及神经、淋巴管(E对)均出入肝门，肝静脉(D错，为本题正确答案)为出入第二肝门的结构。